关于Graves病非浸润性突眼的描述列正确的是
A. 病变常与甲亢治疗好转无关
B. 突眼是由于病变累及球后组织引起的
C. 患者常有视力疲劳、异物感、怕光、流泪等表现
D. 突眼常一般＜18mm
E. 多有眼球胀痛、复视

正确答案：D。突眼常一般＜18mm

解析：Graves病引起的眼部改变大致可分为单纯性突眼与浸润性突眼。单纯性突眼又称非浸润性突眼，突眼度一般＜18mm（D对），与甲状腺毒症所致的交感神经兴奋性增高有关（B错），随着甲亢治疗好转，病变程度多可减轻（A错）。浸润性突眼眼球明显突出，多由于眶后淋巴细胞浸润，眶后成纤维细胞分泌大量黏多糖和糖胺聚糖在组织沉积，透明质酸增多，导致眼外肌和脂肪肿胀损伤，引起突眼（B错），常超过参考值上线3mm以上。病人自诉有眼内异物感、胀痛、畏光、流泪、复视、斜视、视力下降（CE错），查体见眼脸肿胀、肥厚、结膜充血、水肿，严重浸润性突眼者眼球固定，眼睑闭合不全，角膜外露而形成角膜溃疡、全眼炎，甚至失明。